协调性子宫收缩乏力行人工破膜适用的临床情况是
A. 臀先露，宫口开大2cm
B. 足先露，宫口开大4cm
C. 枕先露，S=0，宫口开大4cm
D. 肩先露，宫口开大3cm
E. 胎头高直后位，宫口开大2cm

正确答案：C。枕先露，S=0，宫口开大4cm

解析：当出现协调性宫缩乏力时，行人工破膜的指征为宫口扩张≥3cm、无头盆不称、胎头已衔接（S≥0）而产程延缓者（C对ABD错）。胎头高直后位，宫口开大2cm（E错）（P201）一经确诊，不需人工破膜，应行剖宫产术。